新加香薷饮的功用是
A. 祛暑解表，化湿和中
B. 祛暑解表，清热化湿
C. 清暑解热，化气利湿
D. 清暑化湿，理气和中
E. 祛暑化湿，健脾和中

正确答案：B。祛暑解表，清热化湿

解析：该题考查新加香薷饮的功用。香薷散和新加香薷饮均为祛暑方剂，新加香薷饮是香薷散去扁豆，加金银花、鲜扁豆花、连翘而成，功能祛暑解表，清热化湿（B对）（ACDE错）。